对耐药绿脓杆菌有效的药物是
A. 多西环素
B. 庆大霉素
C. 米诺环素
D. 环丙沙星
E. 诺氟沙星

正确答案：D。环丙沙星